公共场所卫生安全的第一责任人是
A. 卫生监督部门
B. 法定代表人
C. 卫生行政部门
D. 专职卫生管理人员
E. 疾控部门

正确答案：B。法定代表人